关于上颌中切牙的解剖特点说法正确的是
A. 唇面的近远中径大于切颈径
B. 舌面牙颈部有轴嵴
C. 近中邻面接触区在切1/3距切角稍远
D. 邻面观，切嵴位于牙体长轴的唇侧
E. 牙根的舌侧宽于唇侧

正确答案：D。邻面观，切嵴位于牙体长轴的唇侧

解析：本题考查上下颌前牙的外形及临床应用解剖。上颌中切牙：唇面切颈径大于近远中径（A错）；舌侧牙颈部有舌面隆突（B错）；近中邻面接触区在切1/3靠近切角（C错）；邻面观切嵴位于牙体长轴的唇侧（D对）；牙根的唇侧宽于舌侧（E错）。